女，25岁，阴道分泌物增多伴外阴瘙痒3天，妇科检查，阴道黏膜充血，后穹窿有大量稀薄、黄绿色、泡沫状、有臭味分泌物。关于该患者的治疗，不正确的是
A. 需全身治疗
B. 应排除其他性传播疾病
C. 需采用唑类抗真菌药物
D. 性伴侣应同时治疗
E. 对密切接触的毛巾、内裤等应高温消毒

正确答案：C。需采用唑类抗真菌药物

解析：女性患者，阴道分泌物增多伴外阴瘙痒，分泌物稀薄、呈黄绿色（提示合并其他细菌感染）、泡沫状、有臭味（滴虫阴道炎分泌物典型特点），阴道黏膜充血。据患者临床表现，实验室检查，最可能的诊断是滴虫阴道炎（B对），患者常合并其他性传播疾病，诊断时应注意排除。滴虫可存在于身体多处外生殖腺，需全身治疗（A对），临床主要治疗药物为硝基咪唑类药物（如甲硝唑），性伴侣应同时治疗（D对）；该病再感染几率极高，对密切接触的毛巾、内裤等应高温消毒（E对）。唑类抗真菌药物（C错，为本题正确答案）包括咪唑类（酮康唑）、三唑类（伊曲康唑），用于治疗真菌感染。